麻黄辛散温通，微苦略降，处方君药中含麻黄的成药有
A. 小青龙合剂
B. 苏子降气丸
C. 清肺抑火丸
D. 杏苏止咳颗粒
E. 止嗽定喘口服液

正确答案：A、E。小青龙合剂；止嗽定喘口服液

解析：本题考查的是小青龙合剂与止嗽定喘口服液的药物组成。麻黄辛散温通，微苦略降，处方君药中含麻黄的成药有小青龙合剂（A对）、止嗽定喘口服液（E对）。小青龙胶囊：【药物组成】麻黄、桂枝、干姜、细辛、五味子、白芍、法半夏、甘草（炙）。止嗽定喘口服液：【药物组成】麻黄、石膏、苦杏仁、甘草。苏子降气丸（B错）：【药物组成】紫苏子（炒）、半夏（姜制）、厚朴、前胡、陈皮、沉香、当归、甘草。清肺抑火丸（C错）：【药物组成】黄芩、栀子、黄柏、浙贝母、桔梗、前胡、苦参、知母、天花粉、大黄。杏苏止咳颗粒（D错）：【药物组成】苦杏仁、前胡、紫苏叶、桔梗、陈皮、甘草。